下列关于概率的说法，错误的是
A. 通常用P表示
B. 用于描述随机事件发生的可能性大小
C. 某事件发生的频率即概率
D. 在实际工作中，概率常难以直接获得
E. 某事件发生的概率P≤0.05时，称为小概率事件

正确答案：C。某事件发生的频率即概率

解析：本题考查概率的相关内容。度量事件发生可能性大小的数量指标，称为概率（C错，为本题正确答案），通常用P表示（A对），用于描述随机事件发生的可能性大小（B对）。小概率事件是指某事件发生的概率P≤0.05（E对）。在实际工作中，概率常难以直接获得（D对）。